蛛网膜粒的描述，哪项错误
A. 呈“菜花状”突起，突入硬脑膜窦内
B. 于上矢状窦内
C. 脑脊液进入静脉的途径
D. 脑软膜形成
E. 脑蛛网膜形成

正确答案：D。脑软膜形成

解析：脑蛛网膜（E对D错，为本题正确答案）紧贴硬脑膜，在上矢状窦处形成许多“菜花状”状突起（A对），突入上矢状窦内（B对），称蛛网膜粒。脑脊液经这些蛛网膜粒渗入硬脑膜窦内，回流入静脉（C对）。